男，40岁，干部。近1个月出现情绪低落，对工作及娱乐圈没有兴趣，卧床多，不思饮食，入睡困难，早醒，有轻生想法。最可能的诊断是
A. 分裂情感性精神障碍
B. 精神分裂症后抑郁
C. 广泛性焦虑障碍
D. 适应障碍
E. 抑郁发作

正确答案：E。抑郁发作

解析：该中年男性，近1个月以情绪低落为主要表现，对工作及娱乐圈没有兴趣，卧床多，不思饮食（食欲下降），入睡困难、早醒（睡眠障碍），有轻生想法（自杀观念），故诊断为抑郁发作（E对）。广泛性焦虑障碍（焦虑症）以焦虑为主要临床表现，患者常常有不明原因的提心吊胆、紧张不安，无情感低落（忧愁、苦闷、唉声叹气、暗自落泪，严重时可因悲观绝望而出现自杀企图及行为等）的表现，故不考虑（C错）。